患者自诉右上后牙近一个月来进食时有时有疼痛感，经口内诊为右上6隐裂牙，来修复科会诊，该患者的最佳治疗方法是
A. 铸造金属全冠诊断性暂时修复
B. 锤造金属全冠诊断性暂时修复
C. 烤瓷冠诊断性暂时修复
D. 塑料全冠诊断性暂时修复
E. 随诊观察

正确答案：D。塑料全冠诊断性暂时修复

解析：本题考查诊断性暂时修复设计。隐裂牙遇到较大（牙合）力或外力,极易产生牙折，因此应做诊断性暂时修复（D对）对牙齿进行保护，防止牙齿继续折断，同时观察牙髓状况的进展和转归，如果疼痛消失，则改为永久修复；疼痛不消失或加剧，则应根管治疗后再永久修复，不应简单随诊观察（E错），以免隐裂牙裂纹加深。铸造金属全冠（A错）、锤造金属全冠（B错）和烤瓷冠（C错）为永久性修复，塑料全冠为暂时修复，应在诊断性暂时修复塑料全冠戴用一段时间，观察牙髓的进展状况，再考虑永久修复或根管治疗后永久修复，不宜用铸造和锤造金属全冠及烤瓷冠行诊断性暂时修复。